沙门菌属食物中毒的主要临床表现
A. 呼吸数频，面色苍白
B. 共济失调，全身麻痹瘫痪
C. 视力模糊，眼睑下垂，复视
D. 呕吐，腹痛，腹泻，黄绿色水样便
E. 酒醉步，自主神经功能紊乱

正确答案：D。呕吐，腹痛，腹泻，黄绿色水样便

解析：沙门菌属食物中毒的临床表现：潜伏期一般为4到48小时，发病越快病情常越重。中度初期表现为头痛、恶心、食欲减退、继而出现呕吐、腹痛、腹泻和发热。腹泻一日可数次至十余次，主要为黄色或黄绿色水样便，有恶臭，有时带有黏液和脓血。掌握“食品安全”知识点。